某食品公司开发一种新的婴幼儿食品，采用蛋白质功效比值方法评价蛋白质营养价值，实验为动物实验。采用的实验动物应为
A. 雄性断乳大鼠
B. 雌性断乳大鼠
C. 雄性断乳小鼠
D. 雌性断乳小鼠
E. 断乳大鼠雌雄各半

正确答案：A。雄性断乳大鼠

解析：《营养与食品卫生学》第八版P29
蛋白质功效比值是用处于生长阶段中的幼年动物（一般用刚断奶的雄性大白鼠）